诊断试验的真实性是指
A. 被试验的测定值与实际值的符合程度
B. 是重复试验获得相同结果的稳定程度
C. 是观察者对测量结果判断的一致程度
D. 是试验结果表明有无疾病的概率
E. 指病例被试验判为阳性的百分比

正确答案：A。被试验的测定值与实际值的符合程度

解析：本题考查诊断试验的真实性。诊断试验的真实性是指被试验的测定值与实际值的符合程度（A对BCDE错）。